流行性脑脊髓膜炎普通型最主要的临床表现是
A. 高热、昏迷、抽搐、呼吸衰竭
B. 持续性发热、相对缓脉、玫瑰疹
C. 发热、头痛、呕吐、皮肤瘀点、脑膜刺激征
D. 发热、头痛、呕吐、昏迷
E. 高热、惊厥

正确答案：C。发热、头痛、呕吐、皮肤瘀点、脑膜刺激征

解析：流行性脑脊髓膜炎普通型，约占全部发病者的90%以上。前驱期主要表现为低热，咽喉肿痛，鼻咽部黏膜充血和分泌物增多等上呼吸道感染症状。败血症期突然寒战，高热，伴头痛，呕吐，肌肉酸痛等。幼儿可有烦躁与嗜睡交替，尖声哭叫，拒食，腹泻，易惊等症状。大多数患者，发病数小时后全身皮肤、黏膜出现瘀点或瘀斑，直径1mm～1cm，严重者瘀点、瘀斑数量迅速增多。扩大，形成大片坏死或血疱，结膜可有充血。脑膜炎期头痛欲裂，颈痛，呕吐频繁呈喷射性，血压增高而脉搏减慢，狂躁不安，谵语及惊厥，并出现颈项强直、克氏征及布氏征阳性等脑膜刺激征（C对）。